传染病隐性感染特点不包括
A. 感染过程结束后少数人可转变为病原携带状态
B. 病原体感染人体后诱导机体产生特异性免疫应答
C. 不引起或仅引起轻微组织损伤
D. 无明显临床表现
E. 在传染病中少见

正确答案：E。在传染病中少见

解析：病原体感染人体后诱导机体产生特异性免疫应答（B对），不引起或仅引起轻微组织损伤（C对），无明显临床表现（D对），感染过程结束后少数人可转变为病原携带状态（A对），在大多数病毒性传染病中，隐性感染是最常见的表现（E错，为本题正确答案）。